男，2岁。发热、流涕、咳嗽3天，今晨前额及耳后出现浅红色斑丘疹，球结膜充血，口腔黏膜粗糙，声音嘶哑，精神萎靡，两肺呼吸音粗。最可能的诊断是
A. 川畸病
B. 风疹
C. 猩红热
D. 幼儿急疹
E. 麻疹

正确答案：E。麻疹

解析：口腔黏膜粗糙（即麻疹黏膜斑）是幼儿麻疹最特别的临床表现，另外患儿有发热、咳嗽等上感史，发热后额及耳后出现浅红色斑丘疹和球结膜充血都符合麻疹的特点，因此诊断为麻疹（E对）。川畸病一般有高热不退、皮肤红肿、球结膜充血和淋巴结肿大等临床表现，与该病例的特点不符，不能诊断为川崎病（A错）。风疹为发热1～2天（而该患儿已发热3天）后出疹（B错）。猩红热为发热1～2天后出疹，出疹时高热（C错）。高热3～5天，热退疹出是幼儿急疹的典型特征（D错）。